片剂中常用的填充剂有
A. 淀粉
B. 糊精
C. 可压性淀粉
D. 羧甲基淀粉钠
E. 滑石粉

正确答案：A、B、C。淀粉；糊精；可压性淀粉

解析：本题考查片剂的常用辅料。片剂常用的稀释剂主要有淀粉（A对）（包括玉米淀粉、小麦淀粉、马铃薯淀粉，以玉米淀粉最为常用；性质稳定、吸湿性小，但可压性较差）、乳糖（性能优良，可压性、流动性好）、糊精（B对）（较少单独使用，多与淀粉、庶糖等合用）、庶糖（吸湿性强）、预胶化淀粉（又称可压性淀粉（C对），具有良好的可压性、流动性和自身润滑性）、微晶纤维素（MCC，具有较强的结合力与良好的可压性，亦有“干黏合剂”之称）、无机盐类（包括磷酸氢钙、硫酸钙、碳酸钙等，性质稳定）和甘露醇（价格较贵，常用于咀嚼片中，兼有矫味作用）等。羧甲淀粉钠（CMS-Na）（D错）为崩解剂。滑石粉（E错）为润滑剂。